小儿出生时注射疫苗
A. 乙肝和卡介苗
B. 百白破
C. 麻疹
D. 脊髓灰质炎
E. 乙脑

正确答案：A。乙肝和卡介苗

解析：小儿出生时注射的疫苗是乙肝和卡介苗（A对），百白破疫苗（B错）接种的时间为出生后第3个月、4个月、5个月。脊髓灰质炎（D错）疫苗接种的时间出生后2个月，乙脑（E错）疫苗接种的时间为出生后8个月和2岁时。